阿托品引起小便困难、言语不清的剂量
A. 0.5mg
B. 1mg
C. 2mg
D. 5mg
E. 10mg

正确答案：D。5mg

解析：阿托品常见的不良反应有口干、视力模糊、心率加快、瞳孔扩大及皮肤潮红等。随着剂量增大，其不良反应逐渐加重，甚至出现明显中枢中毒症状。5mg：上述症状加重，言语不清，烦躁不安，皮肤干燥，发热，小便困难，肠蠕动减少。掌握“阿托品”知识点。